短效胰岛素的常用给药途径是
A. 皮内注射
B. 皮下注射
C. 肌内注射
D. 静脉注射
E. 静脉滴注

正确答案：B。皮下注射

解析：本题考查注射给药的给药部位和吸收途径。胰岛素口服在胃肠道内易被消化酶破坏，常采用皮下注射（B对）；皮内注射（A错）只用于诊断与过敏试验；肌内注射（C错）注射于肌肉组织，比皮下注射吸收快；静脉注射（D错）、静脉滴注（E错）皆是药物直接进入血液循环的给药方式。